溃疡性结肠炎并发中毒性巨结肠常见诱因是
A. 低血镁
B. 低血钠
C. 低血钾
D. 低蛋白血症
E. 低血钙

正确答案：C。低血钾

解析：溃疡性结肠炎并发中毒性巨结肠常见诱因是低血钾（C对）。重症溃疡性结肠炎患者的结肠病变广泛而严重，炎症累及肌层与肠肌神经丛，肠壁张力减退，低钾可降低胃肠平滑肌的兴奋性，诱发肠麻痹，进一步降低肠壁张力，使结肠蠕动消失，肠内容物与气体大量积聚，致急性结肠扩张，即中毒性巨结肠。钡剂灌肠、使用抗胆碱能药物或阿片类制剂等也可诱发中毒性巨结肠。低血镁（A错）、低血钠（B错）、低蛋白血症（D错）和低血钙（E错）等一般不会诱发中毒性巨结肠。